含量最多的Ig是
A. IgG
B. IgA
C. IgM
D. IgD
E. IgE

正确答案：A。IgG